某女，30岁。素体虚弱，曾经怀孕3次，均无果而终。如今第4次怀孕，妊娠2月余，行走不慎闪挫，遂致小腹隐痛阵作、有下坠感，伴见头晕耳鸣、腰膝酸软，舌淡、苔薄、脉沉弱。治当补肝肾安胎，宜选用的药有
A. 杜仲
B. 续断
C. 白术
D. 菟丝子
E. 桑寄生

正确答案：A、B、D、E。杜仲；续断；菟丝子；桑寄生

解析：本题考查的是杜仲、续断、菟丝子、桑寄生的功效。某女，30岁。素体虚弱，曾经怀孕3次，均无果而终。如今第4次怀孕，妊娠2月余，行走不慎闪挫，遂致小腹隐痛阵作、有下坠感，伴见头晕耳鸣、腰膝酸软，舌淡、苔薄、脉沉弱。治当补肝肾安胎，宜选用的药有杜仲（A对）、续断（B对）、菟丝子（D对）、桑寄生（E对）。杜仲：【功效】补肝肾，强筋骨，安胎。续断：【功效】补肝肾，行血脉，续筋骨。【主治病证】（1）肝肾不足之腰痛脚弱、遗精。（2）肝肾亏虚之崩漏经多，胎漏下血，胎动欲坠。（3）跌仆损伤，金疮，痈疽肿痛。菟丝子：【性味归经】辛、甘，平。归肾、肝、脾经。【功效】补阳益阴，固精缩尿，明目止泻，安胎，生津。桑寄生：【功效】祛风湿，补肝肾，强筋骨，安胎。白术（C错）：【功效】补气健脾，燥湿利水，止汗，安胎。